铸造金属全冠用金合金的特点不包括
A. 硬度与天然牙接近
B. 延展性差
C. 耐腐蚀性强
D. 有利于修复体边缘的密合
E. 生物相容性较好

正确答案：B。延展性差

解析：本题考查铸造金属全冠用金合金的特点。铸造金属全冠用金合金的特点不包括延展性差（B错，为本题的正确答案）。铸造金属全冠用金合金的特点：硬度与天然牙接近（A对）；延展性好；耐腐蚀性强（C对）；有利于修复体边缘的密合（D对）；生物相容性较好（E对）。